患者，男，54岁。常于安静时突发胸骨后疼痛，每次约半小时，含硝酸甘油片不能缓解。心电图示有关导联ST段抬高。诊断为心绞痛，其类型是
A. 稳定型
B. 变异型
C. 卧位型
D. 中间型
E. 恶化型

正确答案：B。变异型

解析：变异型心绞痛胸痛的部位、性质与稳定型心绞痛相似，但具有以下特点之一：原为稳定型心绞痛，在1个月内疼痛发作的频率增加，程度加重，时限延长，诱发因素变化，硝酸类药物缓解作用减弱。1个月内新发生的心绞痛，并因较轻的负荷而诱发。休息状态下发作心绞痛或轻微活动即可诱发，发作时表现为ST段抬高的变异型心绞痛也属此例（B对）。稳定型（A错）疼痛时间短，含服硝酸甘油可以缓解。卧位型（C错）、中间型（D错）、恶化型（E错）均不是心绞痛的常见类型。